对儿童进行乙型肝炎疫苗接种的临床试验研究，为评价其流行病学预防效果，最好选用的指标是
A. 发病率
B. 效果指数
C. 感染率
D. 死亡率
E. 病死率

正确答案：B。效果指数

解析：为评价其流行病学预防效果，最好选用的指标是效果指数（B对），即对照组发病率/接种组发病率。发病率（A错）指某病新发病例出现的频率。感染率（C错）指某病现有感染者人数所占的比例，它是评价人群健康状况常用的指标。死亡率（D错）指某人群中死于某病（或死于所有原因）的频率，它是测量人群死亡危险最常用的指标。病死率（E错）指患某病的全部病人中因该病死亡者所占的比例，它可反映疾病的严重程度和医疗、诊断水平，主要用于病程短且易引起死亡的疾病，多用于急性传染病。